以下哪项是血糖的来源
A. 单糖转变为葡萄糖
B. 肝糖原分解
C. 糖类食物消化吸收
D. 糖异生作用
E. 以上说法都正确

正确答案：E。以上说法都正确

解析：血糖的来源主要有：①食物中的糖经消化吸收进入血中，这是血糖的主要来源。②肝糖原分解，这是空腹时血糖的直接来源。③糖异生作用。④其他的单糖，如果糖、半乳糖等单糖也可转变为葡萄糖，以补充血糖。掌握“磷酸戊糖与血糖调节”知识点。